下列各项，不属下肢丹毒防护要点的是
A. 患者应卧床休息
B. 患者所用敷料、器械须严格消毒
C. 积极治疗脚湿气
D. 多饮开水，床边隔离
E. 保持患肢下垂位，以防热毒上攻

正确答案：E。保持患肢下垂位，以防热毒上攻

解析：下肢丹毒是下肢的急性感染性疾病，应多见患部皮肤突然发红成片、色如涂丹，可抬高患肢30º~40º，使血液回流通畅，减轻局部水肿，保持患肢下垂是不可取的（E对）。患者应卧床休息，避免走动加重下肢肿胀（A错）。急性感染性疾病患者应多饮开水，促进机体代谢产物的排泄；床边隔离，防止感染他人（D错）。同时患者所用敷料、器械须严格消毒，避免多重感染（B错）。因脚湿气导致下肢复发性丹毒患者，应对因治疗，彻底治愈脚湿气，可减少复发（C错）。